女，66岁。有风湿性心脏病和脑卒中史。为预防血栓栓塞，宜长期使用的药物是
A. 华法林
B. 普通肝素
C. 阿司匹林
D. 潘生丁
E. 低分子量肝素

正确答案：A。华法林

解析：患者老年女性，有风湿性心脏病和脑卒中史，而风湿性心脏病最常见的瓣膜疾病是二尖瓣狭窄，因此首先要考虑的是患者可能出现二尖瓣狭窄伴房颤，随之出现血栓栓塞。此时若想预防因房颤导致的血栓栓塞，宜长期使用的药物是华法林（A对），服药期间需维持INR在2.5～3.0之间，能安全有效地预防脑卒中的发生。普通肝素（B错）和低分子量肝素（E错）常用于房颤患者的紧急复律治疗（P190）。阿司匹林（C错）可用于房颤患者的抗栓治疗，但一般仅在无心脏瓣膜病变或CHADS₂=1时考虑使用（八版内科学P189-P190）。潘生丁（九版药理学P267）（D错）又称双嘧达莫，主要用于人工心脏瓣膜置换术后、缺血性心脏病、脑卒中和短暂性脑缺血发作，防止血小板血栓形成。